生存曲线的纵坐标为
A. 死亡概率
B. 生存率
C. 生存概率
D. 生存时间
E. 中位生存时间

正确答案：B。生存率

解析：本题考查生存曲线的构建。生存曲线是以生存时间（ti）为横坐标，各时间点的生存率（B对ACDE错）[S（ti）]为纵坐标。